属于一线抗结核分枝杆菌的药物是
A. 异烟肼、利福平、莫西沙星
B. 异烟肼、阿米卡星、对氨基水杨酸
C. 莫西沙星、卡那霉素、卷曲霉素
D. 异烟肼、吡嗪酰胺、乙胺丁醇
E. 左氧氟沙星、链霉素、利福平

正确答案：D。异烟肼、吡嗪酰胺、乙胺丁醇

解析：本题考查一线抗结核分枝杆菌药。第一线抗结核病药：包括异烟肼、利福平、乙胺丁醇、吡嗪酰胺（D对）、链霉素等为常用抗结核病药，临床疗效好、不良反应少。第二线抗结核病药：包括对氨基水杨酸（B错）、卡那霉素（C错）、乙硫异烟胺、丙硫异烟胺、卷曲霉素、利福喷丁、司帕沙星等，抗菌作用较弱、毒性较大或临床验证不足，主要作为结核分枝杆菌对第一线药物产生耐药性或患者不能耐受第一线药物时的备选药物。莫西沙星（A错）和左氧氟沙星（E错）为喹诺酮类抗菌药。